按照药品说明书和标签管理的规定，药品的最小销售单元系指直接供上市药品的
A. 外包装
B. 内包装
C. 大包装
D. 小包装
E. 所有包装

正确答案：A。外包装

解析：本题考查药品包装的分类。按照药品说明书和标签管理的规定，药品的最小销售单元系指直接供上市药品的（A对）。药品包装的分类：药品的包装分内包装、外包装和最小销售单元包装。（1）内包装（B错）：系指直接与药品接触的包装（如安瓿、注射剂瓶、铝箔等，也叫做“药包材”）。药包材应当能保证药品在生产、运输、贮藏及使用过程中的质量，并便于医疗使用。《药品管理法》第四十六条规定，直接接触药品的包装材料和容器，应当符合药用要求，符合保障人体健康、安全的标准。对不合格的直接接触药品的包装材料和容器，由药品监督管理部门责令停止使用。国家对直接接触药品的包装有严格的规定和标准，如《药品包装材料与药物相容性试验指导原则》（YBB00142002）等相关技术指导原则的要求。2004年7月，国家药品监督管理部门发布《直接接触药品的包装材料和容器管理办法》（局令第13号），要求根据药品的性质选用药包材的材质，开展稳定性试验，考察药包材与药品的相容性；并要求制定注册药包材产品目录，并对目录中的产品实行注册管理。《药品管理法》第二十五条第二款规定，国务院药品监督管理部门在审批药品时，对化学原料药一并审评审批，对相关辅料、直接接触药品的包装材料和容器一并审评，对药品的质量标准、生产工艺、标签和说明书一并核准。禁止使用未按照规定审评、审批的原料药、包装材料和容器生产药品。（2）外包装：系指内包装以外的包装，按由里向外分为中包装和大包装（C错）。外包装应根据药品的特性选用不易破损的包装，以保证药品在运输、贮藏、使用过程中的质量。（3）最小销售单元包装：实际上也是属于外包装，药品的每个最小销售单元的包装必须按照规定印有或贴有标签并附有说明书。